乙型脑炎病毒的主要传播途径是
A. 消化道传播
B. 输血传播
C. 虫媒传播
D. 呼吸道传播
E. 直接接触传播

正确答案：C。虫媒传播

解析：乙型脑炎病毒主要通过蚊叮咬而传播，其主要传播途径属于虫媒传播（P7）（C对），疟疾、流行性斑疹伤寒、地方性斑症伤寒等疾病也可通过虫媒传播。消化道传播（A错）是伤寒杆菌、甲型肝炎病毒、戊型肝炎病毒等病原体的传播途径。输血传播（B错）属于血液、体液传播，是人疟原虫、乙型肝炎病毒、丙型肝炎病毒、HIV等病原体的传播途径（P7）。呼吸道传播（D错）的病毒流感病毒，鼻病毒等病原体的传播途径（P7）。直接接触传播（E错）是钩端螺旋体、钩虫等病原体的传播途径（P7）。